甲状腺功能亢进术后发生甲状腺危象，主要是因为
A. 术中挤压甲状腺
B. 精神过度紧张
C. 手术切除较多
D. 术中未给碘剂
E. 术前准备不充分

正确答案：E。术前准备不充分

解析：甲亢术后发生甲状腺危象与术前准备不够、甲亢症状未能很好控制及手术应激有关，充分的术前准备和轻柔的手术操作是预防的关键（E对）。